参苓白术散的功用是
A. 渗湿
B. 通便
C. 升阳举陷
D. 补血
E. 疏肝

正确答案：A。渗湿

解析：参苓白术散方中以人参补益脾胃之气，白术、茯苓健脾渗湿，共为君药。山药补脾益肺，莲子肉健脾涩肠，扁豆健脾化湿，薏苡仁健脾渗湿，均可资健脾止泻之力，共为臣药。佐以缩砂仁芳香醒脾，行气和胃，化湿止泻。桔梗宣利肺气。炙甘草、大枣补脾和中，调和诸药，而为佐使。诸药相合，益气健脾，渗湿止泻（A对）。麻子仁丸有通便（B错）的功效。补中益气汤有升阳（C错）举陷的功效。炙甘草汤有补血（D错）的功效。逍遥散有疏肝（E错）的功效。